在DNA复制中RNA引物的功能（作用）是
A. 使DNA聚合酶活化并使DNA双链解开
B. 提供5'末端作为合成新DNA链的起点
C. 提供5'末端作为合成新RNA链的起点
D. 提供3'-0H末端作为合成新DNA链的起点
E. 提供3'-0H末端作为合成新RNA链的起点

正确答案：D。提供3'-0H末端作为合成新DNA链的起点